关于腋静脉的叙述正确的是
A. 是头静脉的直接延续
B. 属浅静脉
C. 在胸小肌前面
D. 直接延续于头臂静脉
E. 以上全不对

正确答案：E。以上全不对

解析：腋静脉是两条肱静脉的直接延续，属于深静脉，位于腋动脉的前内侧，直接延续于头臂静脉锁骨下静脉（ABCD对，故E为本题正确答案）。